有机磷农药的急性毒性主要为
A. 肾脏毒性
B. 神经毒性
C. 生殖毒性
D. 血液毒性
E. 肝脏毒性

正确答案：B。神经毒性

解析：本题考查有机磷农药的急性毒性。有机磷农药的急性毒性主要是抑制胆碱酯酶的活性，因乙酰胆碱蓄积，导致胆碱能神经功能紊乱而出现一系列神经系统中毒症状（B对ACDE错）。